子宫脱垂患者，宫颈及部分宫体脱出阴道口，应属
A. Ⅰ度轻
B. Ⅰ度重
C. Ⅱ度轻
D. Ⅱ度重
E. Ⅲ度

正确答案：D。Ⅱ度重

解析：子宫脱垂分为3度：Ⅰ度轻型：宫颈外口距处女膜缘＜4cm，未达处女膜缘；重型：宫颈已达处女膜缘，阴道口可见宫颈。Ⅱ度轻型：宫颈脱出阴道口，宫体仍在阴道内；重型：宫颈及部分宫体脱出阴道口（D对）。Ⅲ度：宫颈及宫体全部脱出阴道口外。